腰穿时发现脑脊液流出、表示穿刺针已到达
A. 硬膜外隙
B. 硬膜下隙
C. 蛛网膜下隙
D. 软膜下隙
E. 椎管

正确答案：C。蛛网膜下隙

解析：脑脊液位于蛛网膜下隙（C对），即脊髓蛛网膜与软脊膜之间的间隙。临床上常在第3、4或第4、5腰椎间行腰椎穿刺，以抽取脑脊液或注入药物（临床上的腰麻）而不伤及脊髓。